关于中药药学服务的说法，错误的是
A. 中药药学服务是以促进合理用药为核心的相关服务
B. 中药药学服务重点要加强中药学专业技术服务
C. 中药药学服务的内容不包括参与临床会诊
D. 提供中药药学服务的药师必须具有良好的人文道德素养
E. 提供中药药学服务的药师必须具备与药学服务相关的药事管理与法规知识

正确答案：C。中药药学服务的内容不包括参与临床会诊

解析：本题考查的是中药药学服务的内容。药学服务的具体工作包括参与临床会诊（C错，为本题正确答案）。中药药学服务是指中药师运用中医药专业知识提供的与用药相关、以提高患者生命质量为目的，以促进合理用药治疗为核心的相关服务（A对）。中药药学服务的主要实施内容包含与患者用药相关的全部需求，因此药学服务的具体工作，除传统的中药处方调剂工作以外，还包括中药处方点评、用药咨询、中药医嘱审核、参与临床查房、开展药学查房、开展药学监护、参与临床会诊、患者用药教育、健康宣教、个体化药学服务及用药安全性检测等多个环节。药学服务是高度专业化的服务过程，要求药师以合理用药为核心，以提高患者生命质量为目的。药师作为医疗团队成员之一服务于患者，必须用自己独有的知识和技能来保证药物使用获得满意的结果。提供药学服务的执业药师必须具有药学专业背景，具备扎实的中医药学专业知识（B对）以及开展药学服务工作的实践经验和能力，并具备与药学服务相关的药事管理与法规知识、人文知识、沟通技巧及高尚的职业道德（DE对）。